肾性水肿首先发生于眼睑部的主要因素是
A. 水肿液的性状
B. 组织结构疏松
C. 重力效应
D. 局部微血管通透性增加
E. 局部淋巴回流障碍

正确答案：B。组织结构疏松

解析：眼睑部组织结构疏松（B对），易容纳水肿液，为肾性水肿的首发部位。心源性水肿时体静脉回流障碍，由于重力效应（C错）首先表现为下垂部位的流体静脉压增高与水肿。肝硬化时肝静脉压和毛细血管流体静压增高，局部微血管通透性增加（D错），易伴发腹水。水肿液的性状（A错）与水肿液的蛋白含量有关，与发生部位无关。局部淋巴回流障碍（E错）为水肿形成原因，与水肿部位无关。